各型牙内陷中舌隆突呈圆锥形突起是
A. 畸形根面沟
B. 畸形舌侧窝
C. 畸形舌侧尖
D. 牙中牙
E. 釉珠

正确答案：C。畸形舌侧尖

解析：本题考查牙内陷。舌隆突呈圆锥形突起是畸形舌侧尖（C对），除舌侧窝内陷外，舌隆突呈圆锥形突起，有时突起成一牙尖。畸形舌侧窝（B错）畸形舌侧窝是牙内陷最轻的一种。由于舌侧窝呈囊状深陷，容易滞留食物残渣，利于细菌滋生，再加上囊底存在发育上的缺陷，常易引起牙髓的感染、坏死及根尖周病变。畸形根面沟（A错）可与畸形舌侧窝同时出现，为一条纵形裂沟，向舌侧越过舌隆突，并向根方延伸，严重者可达根尖部，甚至有时将根一分为二，形成一个额外根。牙中牙（D错）是牙内陷最严重的一种。牙呈圆锥状，且较其固有形态稍大，X线片示其深入凹陷部好似包含在牙中的一个小牙，其实陷入部分的中央不是牙髓，而是含有残余成釉器的空腔。釉珠（E错）是牢固附着于牙骨质表面的釉质小块，大小似粟粒，呈球形，它多位于磨牙根分叉内或其附近，或位于釉牙骨质界的根面上，不属于牙内陷。